星型诺卡菌的感染途径是
A. 肠道
B. 生殖系统
C. 下尿道感染
D. 消化道
E. 呼吸道

正确答案：E。呼吸道